以下有关磷酸锌粘固剂的论述中，不恰当的是
A. 对牙髓有一定的刺激
B. 可作为垫底材料
C. 可用于粘固嵌体、桥、冠
D. 深龋洞可直接用磷酸锌粘固粉垫底
E. 粉末中的主要成分是氧化锌

正确答案：D。深龋洞可直接用磷酸锌粘固粉垫底

解析：磷酸锌粘固剂内的游离磷酸可对牙髓产生刺激；在调制最初的3分钟内pH为3.5，可刺激牙髓；1小时后pH上升到6.0；48小时后就接近中性。因此，深龋洞不应直接用磷酸锌粘固粉垫底，必须先用氧化锌丁香油粘固粉覆盖洞底。掌握“口腔材料的性能与选择、垫底与暂封材料”知识点。